左旋多巴体内过程特点是
A. 口服后主要在胃内吸收
B. 口服后大部分在肾内被吸收
C. 其在外周不能代谢为多巴胺
D. 其进入中枢后经多巴脱羧酶代谢失活
E. 口服进入中枢药物量很少

正确答案：E。口服进入中枢药物量很少

解析：本药口服后主要在小肠（AB错）经主动转运系统而迅速吸收。由于95%以上的左旋多巴在外周被氨基酸脱羧酶脱羧转变为多巴胺（C错），再加上首过消除效应，因而只有1%的原形药物到达脑循环（E对）而在脑内经多巴脱羧酶转化为多巴胺（D错）。